鼻腔粘膜
A. 鼻中隔的粘膜称呼吸区
B. 鼻甲的粘膜称嗅区
C. 鼻中隔表面有丰富的海绵丛
D. 鼻粘膜内有丰富的鼻腺
E. 鼻甲粘膜内有丰富的嗅细胞

正确答案：D。鼻粘膜内有丰富的鼻腺

解析：位于上鼻甲和与其相对的鼻中隔以及二者上方鼻腔顶部的鼻黏膜称嗅区（AB错），富含接受嗅觉刺激的嗅细胞（E错），其余黏膜部分则富含鼻腺称呼吸区（A错D对）。